男，20岁，大二学生。两周来突然兴奋话多，言语夸大，说自己是中国的乔布斯，能开很多家公司，每个都可以进入世界500强。连夜搞发明创造，吃饭都要狼吞虎咽，说要分秒必争，家人朋友劝阻他，他就会发脾气，说他们弱智，不配与自己说话。针对该患者宜首选的药物是
A. 曲唑酮
B. 碳酸锂
C. 氯氮平
D. 米氮平
E. 布普品

正确答案：B。碳酸锂

解析：青年男性患者，两周来突然兴奋话多，言语夸大。吃饭都要狼吞虎咽，说要分秒必争，家人朋友劝阻他，他就会发脾气，说他们弱智，不配与自己说话。综合患者的症状、体征，初步诊断为躁狂发作。锂盐是治疗躁狂发作的首选药物，临床上常用碳酸锂（B对）。氯氮平属于苯二氮䓬类为新型抗精分药物，可作为精分症的首选药物（C错）。曲唑酮、米氮平更加适用于治疗各种抑郁症（AD错）。布普品多用于抑郁症的治疗（E错）。